高血压伴双侧肾动脉狭窄的患者不宜使用的降压药是
A. β受体拮抗剂
B. α受体拮抗剂
C. 利尿剂
D. 钙通道阻滞剂
E. ACEI

正确答案：E。ACEI

解析：ACEI（E对）特别适用于伴有心力衰竭、心肌梗死、蛋白尿、糖耐量下降的高血压患者，不良反应刺激性干咳和血管性水肿。高血钾症、妊娠妇女和双肾动脉狭窄患者禁用。β受体拮抗剂（A错）适用于不同程度的高血压，尤其是心率较快的中、青年患者或合并心绞痛和慢性心力衰竭的患者，不良反应有心动过缓、乏力、四肢发冷。会增加气道阻力，诱发或加重支气管哮喘，所以高血压伴支气管哮喘患者不宜使用。α受体拮抗剂主要用于血管痉挛性疾病和休克治疗，不属于高血压降压药物（B错）。利尿剂（C错）属于常规降压药，主要不良影响是低血钾和影响血脂、血糖和血尿酸的代谢。钙通道阻滞剂（D错）可用于合并糖尿病、冠心病和周围血管疾病患者，主要缺点是引起反射性心率增快、面部潮红、头痛、下肢水肿等。